当外界环境中气温高于皮肤温度时人体散热主要靠
A. 对流
B. 传导
C. 辐射
D. 蒸发
E. 降低产热

正确答案：D。蒸发